女，G1P0。孕32周，感头昏，乏力，食欲差半月余。查：胎心，胎位及骨盆测量均正常。血红蛋白80g/L，血细胞比容25%。较准确的诊断是
A. 巨幼红细胞贫血
B. 缺铁性贫血
C. 地中海贫血
D. 再生障碍性贫血
E. 以上都不是

正确答案：B。缺铁性贫血

解析：该孕妇血红蛋白80g/L（正常值110g/L），血细胞比容25%（正常值31%～34%），可见该孕妇贫血，由于孕妇食欲差半月余，所以进食铁的量较少，造成缺铁，因此较准确的诊断是缺铁性贫血（B对）。巨幼红细胞贫血（A错）是由于叶酸或维生素B12缺乏，常见临床表现为虚胖或颜面水肿，舌炎和舌体疼痛等消化道功能紊乱及手足麻木、无力或蚁行感等神经系统症状，由于孕妇无以上症状，因此不考虑巨幼红细胞贫血。地中海贫血（C错）的常见临床表现为肝脾进行性肿大、黄疸，并有发育不良，由于孕妇无以上症状，因此不考虑地中海贫血。再生障碍性贫血（D错）的典型临床表现为贫血、出血和感染，由于孕妇无出血和感染，因此不支持再生障碍性贫血。